胡某，男性，66岁，鼻咽癌术后放疗，放疗两次后口腔黏膜大面积溃烂，疼痛明显。求治。该患者可能的诊断为
A. 过敏性口炎
B. 接触性口炎
C. 放射性口炎
D. 白色念珠菌感染
E. 急性感染性口炎

正确答案：C。放射性口炎

解析：本题考查放疗化疗性口腔黏膜炎。不同的辐射剂量可产生不同程度的口腔损害，20Gy照射时黏膜充血明显，依次出现糜烂、溃疡，覆盖白色假膜，易出血，触痛明显，有放射线暴露病史以及出现急慢性口腔损害的患者即可确诊为放射性口炎（C对）。过敏性口炎（A错）分为药物过敏性口炎和接触过敏性口炎（接触性口炎）（B错），是指超敏体质者服用药物或接触变应原后口腔局部黏膜出现充血肿胀、渗出糜烂坏死等口腔黏膜炎症性疾病，患者通常有用药史或过敏史，无放射线暴露史。白色念珠菌感染（D错）的临床症状主要为口干、发黏、口腔黏膜烧灼感、疼痛、味觉减退等，患者无癌症放射治疗史。急性感染性口炎（E错）是由细菌、真菌、病毒等微生物感染引起的口腔急性炎症，无放射线暴露史。